关于二重感染下列叙述哪项正确
A. 多种细菌引起的感染
B. 多种致病微生物引起的感染
C. 特殊厌氧菌引起的感染
D. 结核继发化脓菌引起的感染
E. 使用抗生素时、耐药菌株引起的感染

正确答案：E。使用抗生素时、耐药菌株引起的感染

解析：当人体局部或（和）全身的抗感染能力降低时，在使用广谱抗生素或联合使用抗菌药物治疗感染过程中，原来的致病菌被抑制，但耐药菌株如金黄葡萄球菌或白色念珠菌等大量繁殖，致使病情加重。这种情况称为二重感染或菌群交替症。掌握“外科感染”知识点。